女，20岁。右腕部被刀割伤3小时。査体：右手小指掌背侧及环指尺侧感觉障碍。损伤的神经是
A. 腋神经
B. 桡神经
C. 正中神经
D. 肌皮神经
E. 尺神经

正确答案：E。尺神经

解析：患者有右腕部刀割伤史，右手小指掌背侧及环指尺侧感觉障碍（提示有尺神经损伤），结合患者病史和临床表现，该患者损伤的神经为尺神经（E对）。尺神经在腕部损伤主要表现为环、小指“爪形手”畸形，夹纸试验阳性、Froment征及手部尺侧半和尺侧一个半手指感觉障碍，特别是小指感觉消失。腋神经（A错）损伤主要见于肱骨外科颈骨折，其主干损伤后主要表现为臂不能外展、臂旋外力减弱、肩部及臂外侧区上1/3部皮肤感觉障碍。桡神经（B错）在腕部损伤伸腕功能基本正常，仅有伸拇、伸指障碍，无手部感觉障碍。正中神经（C错）在腕部损伤主要表现为拇对掌功能障碍、“猿手”畸形和手的桡侧半感觉障碍。肌皮神经（D错）损伤主要见于肱骨上中段骨折，表现为屈肘无力以及前臂外侧部分皮肤感觉的减弱。